颗粒越小分散度越大，表面积越大，生物活性越强，AS₂O₃细粉状的比粗粉性的毒性大
A. 脂/水分配系数与毒效应
B. 电离度与毒效应
C. 挥发度和蒸气压与毒效应
D. 绝对毒性和相对毒性与毒效应
E. 分散度与毒效应

正确答案：E。分散度与毒效应

解析：本题考查分散度与毒效应。颗粒越小分散度越大，表面积越大，生物活性越强，AS₂O₃细粉状的比粗粉性的毒性大，说明了分散度与毒效应的关系（E对ABCD错）。